9岁患儿，每晚睡前吃饼干，进来发现牙齿上有洞，但无疼痛感，前来就诊。治疗结束时，医生嘱咐其睡前一定要刷牙，尤其要注意刷牙齿的
A. 上牙内面
B. 下牙内面
C. 上牙外面
D. 下牙外面
E. 咬合面

正确答案：E。咬合面